某老企业一接触生产性噪声岗位，工人每天工作4小时，则该岗位的噪声容许标准为
A. ＜88dB（A）
B. ＜90dB
C. ＜90dB（A）
D. ＜93dB
E. ＜93dB（A）

正确答案：A。＜88dB（A）